关于舌板的适应证，下列说法不正确的是
A. 前牙松动需用夹板固定
B. 舌系带附着过高或舌面间隙不能容纳舌杆
C. 舌体经常出现阿弗他溃疡
D. 口底浅，舌侧软组织附着高
E. 舌侧倒凹过大不宜用舌杆

正确答案：C。舌体经常出现阿弗他溃疡

解析：舌板：用于口底浅，舌侧软组织附着高（口底到龈缘的距离在7mm以下）。特别适用于以下情况：前牙松动需用夹板固定者；舌系带附着过高或舌面间隙不能容纳舌杆者；舌侧倒凹过大不宜用舌杆者。掌握“局部义齿连接体”知识点。